选择性COX-2抑制剂罗非昔布产生心血管血不良反应的原因是
A. 选择性抑制COX-2，同时也抑制COX-1
B. 阻断前列环素（PGI₂）的生成，但不能抑制血栓素（TXA₂）的生成
C. 选择性抑制COX-2，但不能阻断前列环素（PGI₂）的生成
D. 选择性抑制COX-2同时阻断前列环素（PGI₂）的生成
E. 阻断前列环素（PGI₂）的生成，同时抑制栓素（TXA₂）的生成

正确答案：B。阻断前列环素（PGI₂）的生成，但不能抑制血栓素（TXA₂）的生成

解析：本题考查罗非昔布产生心血管不良反应的原因。选择性COX-2抑制剂罗非昔布产生心血管血不良反应的原因是阻断前列环素（PGI₂）的生成，但不能抑制血栓素（TXA₂）的生成（B对）。罗非昔布强力抑制COX-2而不抑制COX-1（A错）,导致与COX-2有关的前列环素PGI₂产生受阻而与COX-1有关的血栓素TXA₂合成不受影响，破坏了TXA₂和PGI₂的平衡，从而使血小板聚集和血管收缩增强，理论上会引起心血管不良反应。罗非昔布选择性抑制COX-2，阻断与COX-2有关的前列环素PGI₂的生成（C错）。罗非昔布确实是选择性抑制COX-2同时阻断前列环素PGI₂（D错），但是这并不是罗非昔布产生心血管血不良反应的原因，其原因是罗非昔布阻断与COX-2有关的前列环素PGI₂的生成却并不影响与COX-1有关的血栓素TXA₂的合成，导致TXA₂和PGI₂的平衡受到破坏，所以其原因不是单一的阻断前列环素的生成。罗非昔布不影响与COX-1有关的血栓素TXA₂的合成（E错）。